每天使用一次含氟漱口液为
A. 0.2%NaF（900mg/L）溶液
B. 0.5%NaF（900mg/L）溶液
C. 0.02%NaF（230mg/L）溶液
D. 0.05%NaF（230mg/L）溶液
E. 0.3%NaF（900mg/L）溶液

正确答案：D。0.05%NaF（230mg/L）溶液

解析：含氟漱口液的使用方法：0.05%NaF（230mg/L）溶液：每天使用一次。可交由患者在家使用，若给儿童使用，需在家长的监督下使用。掌握“氟的全身及局部应用”知识点。